下列措施中属于三级预防的是
A. 心理康复
B. 戒烟限酒
C. 体育锻炼
D. 合理营养
E. 早期治疗

正确答案：A。心理康复

解析：本题考查三级预防。第三级预防又称临床预防或疾病管理，发生在疾病的症状体征明显表现出来之后。早期，通过适当的治疗缓解症状，预防疾病进一步恶化，预防急性事件的发生和复发，预防合并症和残疾的发生。到了疾病晚期，通过早期发现和管理合并症，对已经发生的残疾进行康复治疗（A对），最大限度的恢复个体的机体功能和社会功能，提高生活质量，延长寿命。戒烟限酒（B错）、体育锻炼（C错）、合理营养（D错）属于一级预防。早期治疗（E错）属于二级预防。